举止端庄，语言文明，态度和蔼，同情关心和体贴病人是《医务人员医德规范及实施办法》内容要求的
A. 上岗前医德培训
B. 医务人员行为规范
C. 医德考核结果
D. 技术考核结果
E. 文明礼貌服务

正确答案：C。医德考核结果

解析：《中华人民共和国医务人员医德规范及实施办法》第三条医德规范如下：（三）文明礼貌服务。举止端庄，语言文明，态度和蔼，同情、关心和体贴病人（C对ABDE错）。